关于铅中毒临床表现的论述，错误的是
A. 神经衰弱综合征是常见的症状
B. 可出现便秘和腹绞痛
C. 可出现白血病
D. 可出现多发性神经炎
E. 可出现贫血

正确答案：C。可出现白血病